养阴清肺膏善治
A. 风热咳嗽
B. 风寒咳嗽
C. 肺热咳嗽
D. 燥咳无痰
E. 痰湿阻肺

正确答案：D。燥咳无痰

解析：本题考查的是养阴清肺膏主治。养阴清肺膏善治燥咳无痰（D对）。养阴清肺膏：【主治】阴虚燥咳，咽喉干痛，干咳少痰，或痰中带血。川贝止咳露：【主治】风热咳嗽（A错），痰多上气或燥咳。杏苏止咳颗粒：【主治】风寒感冒咳嗽（B错）、气逆。蛇胆川贝散：【主治】肺热咳嗽（C错），痰多。清气化痰丸：【主治】痰热阻肺（E错）所致的咳嗽痰多、痰黄黏稠、胸腹满闷。